可复性牙髓炎区别于急性牙髓炎浆液期的特点是
A. 无温度刺激疼
B. 无化学刺激疼
C. 无自发性疼痛
D. 无探痛
E. 无叩痛

正确答案：C。无自发性疼痛

解析：本题考查可复性牙髓炎与不可复性牙髓炎的区别。急性牙髓炎浆液期属于不可复性牙髓炎，可复性牙髓炎与不可复习牙髓炎的区别关键在于前者无自发痛史，后者一般有自发痛史（C对）。可复性牙髓炎与不可复性牙髓炎均有温度刺激疼（A错）、化学刺激疼（B错），可复性牙髓炎温度刺激时出现一过性疼痛，刺激去除后疼痛立即消失，急性牙髓炎浆液期温度刺激出现剧烈疼痛，刺激去除后疼痛持续一段时间。二者都会出现探痛（D错），急性牙髓炎浆液期比可复体牙髓炎探痛更明显。二者均是牙髓炎均没有叩痛（E错），不能通过叩痛鉴别。